大剂量使用，透皮吸收后对神经系统产生毒性，有诱发癫痫危险的药品是
A. 维A酸软膏
B. 克罗米通乳膏
C. 硫磺软膏
D. 酮康唑乳膏
E. 林旦乳膏

正确答案：E。林旦乳膏

解析：本题考查林旦乳膏。大剂量使用，透皮吸收后对神经系统产生毒性，有诱发癫痫危险的药品是林旦乳膏（E对）。长期大量使用林旦，可能由于药物经皮肤吸收，对肝、肾功能及中枢神经系统产生毒害，诱发癫痫等。维A酸软膏（A错）对急性或亚急性皮炎患者、湿疹类皮肤患者禁用。克罗米通乳膏（B错）可引起接触性皮炎，偶见过敏反应。硫磺软膏（C错）长期大量局部用药，具有刺激性，可引起接触性皮炎，避免接触眼部及其他黏膜，儿童慎用。酮康唑乳膏（D错）使用后偶见局部刺激，瘙痒、烧灼感、接触性皮炎，皮肤可出现红斑、丘疹水疱脱屑等。